引起胁痛的病证有
A. 肝气不舒
B. 肝火郁滞
C. 肝胆湿热
D. 肝肾亏虚
E. 悬饮

正确答案：A、B、C、E。肝气不舒；肝火郁滞；肝胆湿热；悬饮

解析：本题考查的是不同部位疼痛的临床意义。引起胁痛的病证有肝气不舒（A对）、肝火郁滞（B对）、肝胆湿热（C对）与悬饮（E对）。胁痛：胁为肝胆二经分布的部位。如肝气不疏、肝火郁滞、肝胆湿热、血瘀气滞以及悬饮等病变，都可引起胁痛。肝肾亏虚（D错）为痛经的辨证。痛经肝肾亏虚证可见经期或经后小腹绵绵作痛，经行量少，色暗淡，质稀薄；腰膝酸软，头晕耳鸣；舌淡红，苔薄，脉沉细。